高血压合并糖尿病患者，为避免掩盖低血糖症状，应慎用的药物是
A. β受体阻断剂
B. 噻嗪类利尿剂
C. α受体阻断剂
D. 二氢吡啶类钙通道阻滞剂
E. 血管紧张素转换酶抑制剂

正确答案：A。β受体阻断剂

解析：本题考查降压药。高血压合并糖尿病患者，为避免掩盖低血糖症状，应慎用的药物是β受体阻断剂（A对）。β受体阻滞剂会增加糖尿病患者的胰岛素抵抗，而且β受体阻滞剂会掩盖糖尿病患者的低血糖症状，高血压合并糖尿病患者应慎用。噻嗪类利尿剂（B错）慎用于糖尿病合并高尿酸血症的患者。α受体阻断剂（C错）适用于高血压伴前列腺增生症患者。二氢吡啶类钙通道阻滞剂（D错）适用于老年高血压，单纯收缩期高血压，伴稳定型心绞痛、冠状动脉或颈动脉粥样硬化及周围血管疾病患者。血管紧张素转换酶抑制剂（ACEI）（E错）适用于高血压合并糖尿病患者。